皮质脊髓束大部分纤维交叉位置位于
A. 锥体交叉平面
B. 橄榄体中段平面
C. 内侧丘系交叉平面
D. 中脑上丘平面
E. 脊髓

正确答案：A。锥体交叉平面

解析：皮质脊髓束参与构成锥体系，其大部分纤维交叉位置位于锥体交叉平面（A对），在锥体下端，约75% -90%的纤维交叉至对侧，形成锥体交叉。